归经的理论基础是
A. 阴阳学说
B. 五行学说
C. 运气学说
D. 整体观念
E. 脏腑经络理论

正确答案：E。脏腑经络理论

解析：该题考查的是中药归经理论。脏腑经络理论主要阐述脏腑与经络之间的关系，中药归经理论的形成是在中医基本理论指导下以脏腑经络学说为基础，以药物所治疗的具体病证为依据，经过长期临床实践总结出来的用药理论（E对）。阴阳学说认为：世界是物质性的整体，宇宙间一切事物不仅其内部存在着阴阳的对立统一，而且其发生、发展和变化都是阴阳二气对立统一的结果（A错）。五行学说用木、火、土、金、水五种物质来说明世界万物的起源和多样性的统一（B错）。运气学说主要包括五运（即木、火、土、金、水五行的运动）和六气（即风、寒、暑、湿、燥、火六种气候的变化）（C错）。整体观念是中医学关于人体自身的完整性及人与自然、社会环境的统一性认识（D错）。